以病证类药，创设“诸病通用药”专项的本草典籍是
A. 《神农本草经》
B. 《本草经集注》
C. 《本草纲目》
D. 《新修本草》
E. 《重修政和本草》

正确答案：B。《本草经集注》

解析：本题考查《本草经集注》的主要成就。以病证类药，创设“诸病通用药”专项的本草典籍是《本草经集注》（B对）。《本草经集注》该书的主要成就包括：①全书7卷，是《本经》之后对我国中药学进行的又一次总结，系统整理了南北朝以前的药物学资料。②创立了新的编写体例：药物分类按自然属性进行区分，改进了《本经》三品分类法；所载药物内容采用朱墨、大小字体分书法，保持了引录文献的原有面貌。③创设了“诸病通用药”专项，以病证类药，如治风项有防风、防己、独活等，治小便淋沥有滑石、冬葵子等，治瘿瘤有海藻、昆布等，利于临证遣药参考。④记载了对药物性能的认识，书中记载药性有寒、微寒、大寒、平、淡、微温、大温、大热等八种，体现对药性寒温程度有了进一步认识。对前人所述的药物功能则根据临床观察提出疑问，如丹参条称“时人服多赤眼，故应性热，今云微寒，恐为谬矣”；天名精条称“味至苦而云甘，恐或是非”等。⑤记载了药物产地、形态与鉴别经验。书中对当时各种药物的产地做了介绍，强调产地不同，药性有异。在形态方面描述也甚详。⑥重视药物的炮制与配制前的加工。书中介绍了各种药物炮制法，如称麦门冬要抽去心，“不尔令人烦”；半夏要用？“汤洗十许过令滑净，不尔戟人咽喉”，强调了通过炮制能减轻药物的毒副反应。在配制丸、散时，指出巴豆、杏仁、胡麻等药要先熬黄，则“丸经久不坏”等，都有指导意义。《神农本草经》（A错）该书是最早的本草学专著，具有重要的科学价值和历史影响，为我国医药学四大经典著作之一。《本草纲目》（C错）此书可谓中药学巨著，内容广博，收罗繁富。全书引据历代本草凡84家，古今医书目277种，另从经史子集各部著作中引录了大量有关的文献资料，参考文献共计800余种。书中共收载药物1892种，方剂11096首，附有药物图谱1109幅。《新修本草》（D错）又称《唐本草》。为隋唐年间长孙无忌、李勣领衔，苏敬等人在《本草经集注》一书的基础上重修而得。由于《新修本草》的完成依靠了国家的行政力量和人力物力，故称该书为中国历史上第一部官修本草。全书共54卷，载药850种。书中除本草正文外，增加了图谱，并附以文字说明，开创了图文对照编纂药学专著的先例，是我国历史上第一部药典性本草，也被誉为世界上第一部药典。《重修政和经史证类备用本草》简称《重修政和本草》（E错）。全书共30卷，载药大约为1746种。该书为现存最早的完整的古本草合刊本，人民卫生出版社1957年影印，广为流传。